红花花粉粒的特征是
A. 极面观呈三角形，赤道面观双凸镜形．具4副合沟
B. 类球形或长圆形，表面有点状条形雕纹，自两极向四周呈放射状排列
C. 球形，外壁具刺状突起，萌发孔4个
D. 圆球形，表面光滑
E. 类圆形，表面有网状雕纹

正确答案：C。球形，外壁具刺状突起，萌发孔4个